黏液表皮样癌最常发生在
A. 腮腺
B. 下颌下腺
C. 舌下腺
D. 唇腺
E. 腭腺

正确答案：A。腮腺

解析：本题考查黏液表皮样癌的好发部位。黏液表皮样癌是唾液腺恶性肿瘤中最常见者，发生于腮腺者居多（A对）。唾液腺结石病最常发生于下颌下腺（B错）。发生于舌下腺（C错）的肿瘤多为腺样囊性癌。黏液囊肿好发于唇腺（D错）。小涎腺肿瘤多发生于腭腺（E错）。